高血压合并消化性溃疡者不应服用
A. 利血平
B. 氧化镁
C. 碳酸氢钠
D. 青霉素
E. 红霉素

正确答案：A。利血平

解析：本题考查利血平。高血压合并消化性溃疡者不应服用利血平（A对）。消化性溃疡患者在服用利血平的过程中，胃酸会分泌过多，胃酸堆积会腐蚀肠黏膜，进而加重溃疡。氧化镁（B错）、碳酸氢钠（C错）均为为抗酸药，具有促进溃疡愈合和缓解疼痛的作用。